吸气性呼吸困难常见于
A. 慢性支气管炎
B. 气管异物
C. 支气管哮喘
D. 肺炎球菌肺炎
E. 阻塞性肺气肿

正确答案：B。气管异物

解析：吸气性呼气困难主要见于喉部、气管、大支气管阻塞与狭窄，如气管异物（B对）等。慢性支气管炎（A错）、支气管哮喘（C错）、肺炎球菌肺炎（D错）和阻塞性肺气肿（E错）时，患者表现为呼气性呼吸困难（P23）。